可鉴别小檗碱的反应是
A. 碘化铋钾反应
B. 三氯化铁反应
C. 异羟肟酸铁反应
D. 盐酸-镁粉反应
E. 乙酰化反应

正确答案：A。碘化铋钾反应

解析：本题考查的是小檗碱的鉴别反应。可鉴别小檗碱的反应是碘化铋钾反应（A对）。小檗碱为生物碱，可用碘化铋钾反应鉴别。碘化铋钾反应为常用的生物碱沉淀反应。反应特征：黄色至橘红色无定形沉淀。小檗碱除了能与一般生物碱沉淀试剂产生沉淀反应外，还具有以下特征鉴别反应：（1）丙酮加成反应；（2）漂白粉显色反应。碘化铋钾反应为常用的生物碱沉淀反应。反应特征：黄色至橘红色无定形沉淀。三氯化铁反应（B错）：具有酚羟基的香豆素类可与三氯化铁试剂产生颜色反应，通常是蓝绿色。异羟肟酸铁反应（C错）：由于香豆素类具有内酯环，在碱性条件下可开环，与盐酸羟胺缩合成异羟肟酸，然后再在酸性条件下与三价铁离子络合成盐显红色。盐酸-镁粉反应（D错）：是鉴定黄酮类化合物最常用的显色反应。乙酰化反应（E错）：最常用的糖及苷的酰化反应是乙酰化和甲苯磺酰化。乙酰化反应所用溶剂多为醋酐，催化剂多为吡啶、氯化锌、醋酸钠等，通常在室温放置下即可获全乙酰化物。